属反治法的是
A. 热者寒之
B. 寒因寒用
C. 虚则补之
D. 实则泻之
E. 寒者热之

正确答案：B。寒因寒用

解析：本题考查的是反治。属反治法的是寒因寒用（B对）。反治，又称从治，是指顺从疾病证侯的外在假象而治的治疗法则。表面上，反治是顺从疾病证候的外在假象而治，究其实质，还是在“治病求本”指导下，针对疾病证候的本质而进行治疗。反治，主要包括热因热用、寒因寒用、塞因塞用、通因通用四种治法。热者寒之（A错）、虚则补之（C错）、实则泻之（D错）与寒者热之（E错）属于正治。正治，又称逆治，是指采用方药的性质与疾病的证候性质相反的治疗法则。正治是临床上最常用的一种治疗法则。常用的治法有寒者热之、热者寒之、虚则补之、实则泻之等。